三臂卡环的组成是由
A. 颊卡环臂
B. 舌卡环臂
C. （牙合）支托
D. A+B
E. A+B+C

正确答案：E。A+B+C

解析：本题考查局部义齿固位体。三臂卡环：多用于牙冠外形好，无明显倾斜的基牙。卡环由颊、舌两个卡环臂（AB对）和（牙合）支托（C对）组成。因此，选E。